根据《药品管理法》，下列情形不属于假药的是
A. 与国家药品标准规定成份不符的化学药
B. 变质的中药饮片
C. 标明适应症超出规定范围的生物制品
D. 被污染的中成药

正确答案：D。被污染的中成药

解析：本题考查假药和劣药的判定。根据《药品管理法》，下列情形不属于假药的是被污染的中成药（D错，为本题正确答案）。有下列情形之一的，为劣药：（一）药品成份的含量不符合国家药品标准；（二）被污染的药品；（三）未标明或者更改有效期的药品；（四）未注明或者更改产品批号的药品；（五）超过有效期的药品；（六）擅自添加防腐剂、辅料的药品；（七）其他不符合药品标准的药品。有下列情形之一的，为假药：（一）药品所含成份与国家药品标准规定的成份不符（A对）；（二）以非药品冒充药品或者以他种药品冒充此种药品；（三）变质的药品（B对）；（四）药品所标明的适应症或者功能主治超出规定范围（C对）。